男，21岁，右侧颞部受击伤后昏迷30分钟，清醒5小时后又转入昏迷，伴右侧瞳孔散大，左侧肢体瘫痪。首先考虑的诊断是
A. 右侧急性硬脑膜外血肿
B. 右侧急性硬脑膜下积液
C. 脑干损伤
D. 右侧脑挫伤
E. 左侧脑内血肿

正确答案：A。右侧急性硬脑膜外血肿

解析：青年男性患者，右侧颞部受伤后昏迷30分钟，清醒后又转入昏迷（急性硬膜外血肿的典型表现），右侧瞳孔散大，左侧肢体瘫痪（右侧小脑幕切迹疝的表现），结合患者病史和临床表现，应首先考虑的诊断为右侧急性硬膜外血肿（A对）合并小脑幕切迹疝。急性硬膜下积液（B错）又称硬膜下水瘤，指硬脑膜下腔出现脑脊液积聚，主要表现为头痛、恶心、呕吐等颅内高压和局部脑组织受压的症状和体征，可有意识障碍，但无中间清醒期。脑干损伤（C错）表现为伤后立即昏迷并进行性加重，瞳孔大小多变，早期发生呼吸、循环功能衰竭，可出现去皮质强直及双侧病理征阳性。脑挫裂伤（P188）（D错）主要表现为头痛、呕吐、恶心及伤后立即出现的意识障碍，无中间清醒期，瞳孔改变少见，偏瘫等局灶症状和体征多于伤后立即发生。脑内血肿（E错）常与急性硬膜下血肿同时存在，临床表现与硬膜外血肿相似，但意识障碍表现为持续性或进行性加重，无中间清醒期。